低钾血症最早的临床表现是
A. 厌食
B. 肌无力
C. 腹胀
D. 心动过缓
E. 反常性酸性尿

正确答案：B。肌无力

解析：本题考查低钾血症最早的临床表现。低钾血症最早的临床表现是肌无力（B对）。低钾血症最早的临床表现是肌无力，先是四肢软弱无力，以后可延及躯干和呼吸肌，一旦呼吸肌受累，可致呼吸困难或窒息。厌食（A错）、腹胀（C错）、心动过缓（D错）、反常性酸性尿（E错）均可见于低血钾症，但不是最早的临床表现。